属于症状的是
A. 心绞痛
B. 风湿性关节炎
C. 颈静脉怒张
D. 甲状腺功能亢进
E. 焦虑

正确答案：E。焦虑

解析：症状是指患者主观体验到的不适或痛苦的异常感觉或某些客观存在的病态表现。它是疾病存在的早期信号，其表现特点常为诊断、鉴别诊断提供重要的依据和线索。症状表现形式多样，有些是主观感觉，如心悸、恶心、眩晕等；有些只有客观表现，如腹部包块等；也有些既有主观感觉，也有客观表现，如发热、黄疸、水肿等。广义的症状，包括一些体征，即客观存在的异常表现，医师进行体格检查常可发现，故焦虑属于症状（E对）。